关于多囊卵巢综合征的内分泌错误的是
A. 雄激素过多
B. LH/FSH比值升高
C. 雌酮过多
D. 胰岛素过多
E. 孕酮过多

正确答案：E。孕酮过多

解析：多囊卵巢综合征的内分泌特征有：①雄激素过多（A对）；②雌酮过多（C对）；③黄体生成激素/卵泡刺激素（LH/FSH）比值增大（B对）；④胰岛素过多（D对）。本病可用孕酮（E错，为本题正确答案）调节月经并保护子宫内膜，抑制LH过度分泌，并对抗雄激素等作用治疗。